暴露组的发病率或死亡率与对照组同种率之差
A. 率比（RR）
B. 优势比（OR）
C. 人时发病率
D. 归因危险度
E. 病因分值

正确答案：D。归因危险度

解析：本题考查归因危险度的概念。归因危险度（D对ABCE错）（AR）又叫特异危险度、危险度差和超额危险度，是暴露组发病率与对照组发病率相差的绝对值，它表示危险特异地归因于暴露因素的程度。